9～11岁学生业余体育训练的适宜量为
A. 每周训练1～2次，每次0.5小时
B. 每周训练1～2次，每次1小时
C. 每周训练2～3次，每次1～1.5小时
D. 每周训练3～4次，每次1～1.5小时
E. 每周训练3～4次，每次2时

正确答案：A。每周训练1～2次，每次0.5小时